下列有关酶的概念和作用的叙述，正确的是
A. 生物体内的无机催化剂
B. 催化活性都需要特异的辅酶
C. 对底物都有绝对专一性
D. 能显著地降低反应活化能
E. 体内催化作用不受任何调控

正确答案：D。能显著地降低反应活化能